罹患率可以表示为
A. （观察期内的病例数÷同期平均人口数）✕100%
B. （观察期内的新病例数÷同期暴露人口数）✕100%
C. （一年内的新病例数÷同年暴露人口数）✕100%
D. （观察期内的新病例数÷同期平均人口数）✕100%
E. （观察期内的新旧病例数÷同期暴露人口数）✕100%

正确答案：B。（观察期内的新病例数÷同期暴露人口数）✕100%

解析：本题考查罹患率的计算公式。罹患率＝（观察期间某病新病例数/同期暴露人口数）×K（B对ACDE错）。K的取值常为100%，1000‰。